右心室流入道和流出道的分界是
A. 隔缘肉柱
B. 室上嵴
C. 三尖瓣前瓣
D. 前乳头肌
E. 三尖瓣隔瓣

正确答案：B。室上嵴

解析：室上嵴（B对）为右心室流入道和流出道的分界，为一弓形的肌性隆起。